在《中国药典》中，使用抗生素微生物检定法作为含量测定方法的药物是
A. 盐酸四环素
B. 地西泮
C. 硝苯地平
D. 异烟肼
E. 硫酸庆大霉素

正确答案：E。硫酸庆大霉素

解析：本题考查含量测定。在《中国药典》中，使用抗生素微生物检定法作为含量测定方法的药物是硫酸庆大霉素（E对）。硫酸庆大霉素为氨基糖苷类抗生素，可使用抗生素微生物检定法进行含量测定。盐酸四环素（A错）的含量测定采用高效液相色谱法。地西泮（B错）的含量测定采用非水碱量法。硝苯地平（C错）的含量测定采用铈量法。异烟肼（D错）的含量测定采用氧化还原滴定法。